与结石形成关系不太密切的因素是
A. 气候因素
B. 情志内伤
C. 饮食不当
D. 体质差异
E. 服药不当

正确答案：A。气候因素

解析：本题考察结石的形成。结石是指体内某些部位形成并停滞为病的砂石样病理产物或结块，主要致病因素为饮食不当、情志内伤、服药不当、体质差异；与气候因素关系不太密切（A错，为本题正确选项）。若情志不遂，肝气郁结，疏泄失职，可导致胆气不利，胆汁淤积，排泄受阻，日久也可形成胆结石（B对）。饮食偏嗜，喜食肥甘厚味，影响脾胃运化，蕴生湿热，内结于胆，久则可形成胆结石。湿热下注，蕴结于下焦，导致肾的气化失司，日久可形成肾结石或膀胱结石。空腹食入过多的未熟柿子、黑枣等，可影响胃的受纳和通降，形成胃结石。此外，某些地域的水质中含有过量的矿物及杂质等，也是促使结石形成的原因之一（C对）。由于先天禀赋及后天因素引起的体质差异，导致对某些物质的代谢异常，从而易于在体内形成结石（D对）。长期过量服用某些药物，致使脏腑功能失调，或药物代谢产物沉积于局部，是形成肾或膀胱结石的原因之一（E对）。